男性，20岁。被手榴弹炸伤右侧大腿3小时来院。查体：一般情况好，生命体征平稳，右大腿外侧有约6cm×3cm伤口，深达深筋膜表面，无活动性出血，检査无弹片残留。正确的处理是
A. 彻底清创后，缝合伤口
B. 彻底清创，切开深筋膜减压
C. 清洗伤口，消毒包扎
D. 彻底清创后，开放伤口引流
E. 彻底清创后，放置引流缝合伤口

正确答案：D。彻底清创后，开放伤口引流

解析：火器伤的局部治疗主要是尽早清创（C错），充分暴露伤道，清除坏死和失活的组织，清创后不宜一期缝合（A错），因为初期清创时，挫伤区和震荡区参差交错，不易判断。此时应彻底清创，开放伤口引流（D对）3～5天后，酌情延期缝合（E错）。若无深部损伤，则不需要切开深筋膜减压（B错），以免扩大创伤。